男性，54岁。间歇上腹不适4年，餐后加重，嗳气，但无明显消瘦，胃液分析：基础胃酸分泌量（BAO）为0（正常值1~2mmol/h），最大胃酸分泌量（MAO）为5mmol/h（正常值17~23mmol/h），壁细胞总数（PCM）为2.5x10⁸个，最可能诊断为
A. 慢性浅表性胃炎
B. 十二指肠球部溃疡
C. 胃溃疡
D. 慢性萎缩性胃炎
E. 胃癌

正确答案：D。慢性萎缩性胃炎